嵌体洞形与充填洞形的区别，除了
A. 轴壁外展2°～5°
B. 邻面可作片切形
C. 备洞时作预防性扩展
D. 有洞缘斜面
E. 可作邻沟

正确答案：C。备洞时作预防性扩展

解析：本题考查嵌体洞形与充填洞形的区别。嵌体洞形与充填洞形的区别，除了备洞时作预防性扩展（C错，为本题的正确答案）。两者备洞时都要作预防性扩展，使洞缘位于健康牙体组织内，可以减少继发龋的发生，这是共同点。嵌体制备要求所有轴壁不能有倒凹，相对轴壁平行或者外展不超过6°，轴壁外展2°～5°（A对）是合适的，充填体是利用窝洞的倒凹来固位的。邻（牙合）嵌体除（牙合）面洞型外，还可以增加辅助固位形，如邻面片切（B对）、邻沟（E对），充填体不能使用邻面片切和邻沟。对于金属嵌体，洞缘处要制备洞缘斜面（D对）以去除无机釉、减少微渗漏、避开咬合接触点。